痛经之所以随月经周期而发作，下列哪项有关
A. 寒凝胞中
B. 经期胞中血虚邪盛
C. 经期冲任气血变化急骤
D. 冲任血虚、胞宫失养
E. 湿热蕴结胞中

正确答案：C。经期冲任气血变化急骤

解析：痛经之所以伴随月经周期而发，与经期及经期前后特殊生理状态有关。未行经期间，由于冲任气血平和，致病因素尚不足以引起冲任、子宫气血瘀滞不足，故平时不发生疼痛。经期前后，血海由满盈而泄溢，气血由盛实而骤虚，子宫、冲任气血变化较平时急剧，易受致病因素干扰，加之体质因素的影响，导致子宫、冲任气血运行不畅或失于濡养，不通或不荣而痛，经净后子宫、冲任之气渐复则疼痛自止。但若病因未除，素体状况未获改善，则下次月经来潮，疼痛又复发矣（C对）。外感寒邪，或过食寒凉生冷，寒客冲任，与血相搏，以致子宫、冲任气血不畅，不通则痛，寒凝胞中为痛经的一个病因，不会导致随月经周期而发作（A错）。气血虚弱，化源不足，冲任气血虚少，不能濡养子宫、冲任，不荣则痛，经期胞中血虚邪盛为痛经的一个病因，不会导致随月经周期而发作（B错）。血虚，不能濡养冲任、胞宫，不荣则痛，冲任血虚、胞宫失养为痛经的一个病因，不会导致随月经周期而发作（D错）。素体湿热内蕴，或经期、产后摄生不慎感受湿热之邪，与血相搏，流注冲任，蕴结胞中，气血失畅，不通则痛。湿热蕴结胞中为痛经的一个病因，不会导致随月经周期而发作（E错）